女，50岁，2周前无明显诱因出现中上腹隐痛，皮肤巩膜黄染，小便呈浓茶样，1周前腹痛缓解，皮肤黄染减退，无皮肤瘙痒，实验室检查；ALT90U/L，尿胆红素（＋），该患者最可能的疾病与胰头癌的鉴别诊断要点是
A. 黄疸有无波动
B. 血清淀粉酶改变
C. 皮肤有无瘙痒
D. 尿胆红素阳性
E. 肝功能改变

正确答案：A。黄疸有无波动

解析：患者中上腹隐痛，皮肤巩膜黄染，小便呈浓茶样，黄疸有波动，ALT升高，尿胆红素阳性。该患者最可能的疾病为壶腹癌。胰头癌可有上腹隐痛，皮肤巩膜黄染，小便深黄，大便陶土色，转氨酶也可轻度升高，尿胆红素阳性。但胰头癌黄疸的特点是进行性加重，由于癌肿压迫或浸润胆总管所致。壶腹癌和胰头癌的鉴别诊断要点是黄疸有无波动（A对）。